属于口腔癌一级预防措施的是
A. 早发现
B. 早诊断
C. 早治疗
D. 病因预防
E. 防止复发

正确答案：D。病因预防

解析：本题考查口腔癌的分级预防。属于口腔癌一级预防措施的是病因预防（D对）。早发现（A错）、早诊断（B错）、早治疗（C错）属于口腔癌二级预防措施。防止复发（E错）属于口腔癌三级预防措施。